新生隐球菌具有诊断价值的形态特点是
A. 有假菌丝
B. 形成厚膜孢子
C. 有异染颗粒
D. 菌体外有一层肥厚的荚膜
E. 在菌体次极端，有直径大于菌体的芽胞

正确答案：D。菌体外有一层肥厚的荚膜

解析：新生隐球菌，即新型隐球菌外周有一层肥厚的胶质荚膜，用墨汁负染后直接镜检可见在黑色背景中见到折光性强的菌体，周围有一圈透明的肥厚荚膜，是其具有诊断价值的形态特点，可以用于确诊（D对）。有假菌丝（A错）、形成厚膜孢子（B错）是白假丝酵母菌的生物学特征（P339）。异染颗粒（C错）是白喉棒状杆菌的生物学特性，主要成分是核糖核酸和多偏磷酸盐，对鉴定细菌具有重要意义（P164）。在菌体次极端，有直径大于菌体的芽胞（E错）的是肉毒梭菌（P20）。